为避免病情加重，在服用抗甲状腺素药治疗期间应当禁用的药品有
A. 泼尼松
B. 利血生
C. 碘番酸
D. 碘化钾
E. 胺碘酮

正确答案：C、D、E。碘番酸；碘化钾；胺碘酮

解析：本题考查药物相互作用。碘番酸（C对）、碘化钾（D对）、胺碘酮（E对）均含碘，服用抗甲状腺药物期间应禁用。泼尼松（A错）和利血生（B错）均不含碘，与抗甲状腺素药无药物相互作用。